患者，女，30岁。发现下腹包块1月余小腹胀痛，痛无定处，舌苔薄润，脉沉弦其证候是
A. 血瘀
B. 寒凝
C. 气滞
D. 痰湿
E. 湿郁

正确答案：C。气滞

解析：气血瘀结，滞于胞宫冲任，积结日久，结为肿块，气滞则经脉气血运行受阻，气血紊乱，胀满疼痛，脉沉弦。气滞所以痛无定处（C对）。血瘀表现为下腹部结块，触痛；月经量或多或少，经行腹痛较剧，经色紫黯有块，脉弦细等症状（A错）。寒凝肢冷、下腹部拘急冷痛，遇热痛减，无汗、面白或青、苔白、脉沉紧甚至脉伏等症（B错）。痰湿证以下腹结块，触之不坚，固定难移，经行量多，淋漓难净，经间带下增多，胸皖痞闷，腰腹疼痛，舌体胖大，紫黯，脉弦滑等为主要表现的证候（D错）。湿郁证以下腹肿块，按之不移，身体困重、肢体酸痛，脉弦滑数等为主要表现的证候（E错）。